男，41岁。腰痛伴右下肢放射痛3月，反复发作，与劳累有关，咳嗽或用力排便时可加重疼痛。查体右直腿抬高试验40°阳性，加强试验阳性。X线片示：L4～5椎间隙变窄。该患者右下肢麻木的区域可能为
A. 小腿外侧或足背
B. 大腿前侧
C. 小腿前内侧
D. 小腿及足外侧、足底
E. 臀部及大腿后侧

正确答案：A。小腿外侧或足背

解析：多数椎间盘突出病人常伴有感觉异常。腰4～5间盘突出，即腰5神经受累，患者将出现小腿外侧或足背的痛、触觉减退（A对）。大腿前侧（B错）为腰2神经受压。小腿前内侧（C错）为腰4神经受压。小腿及足外侧、足底（D错）为骶1神经受压。臀部及大腿后侧（E错）受腰1～3及骶1～3的混合支配。